辐射引起机体产生大量自由基，导致机体消耗增加的是
A. 膳食纤维
B. 维生素
C. 矿物质
D. 水分
E. 能量

正确答案：B。维生素

解析：本题考查辐射对维生素代谢的影响。由于辐射引起机体产生大量的活性氧自由基，促进了抗氧化维生素（如维生素C、维生素E和β-胡萝卜素等）（B对ACDE错）的消耗。